氯压定按常用治疗量出现血压骤降，属于
A. 副作用
B. 毒性反应
C. 后遗效应
D. 继发反应
E. 首剂效应

正确答案：E。首剂效应

解析：本题考查药品的不良反应。首剂效应（E对）是指一些患者在初服某种药物时，由于机体对药物作用尚未适应而引起不可耐受的强烈反应，例如氯压定按常用治疗量出现血压骤降。副作用（A错）是指在药物按正常用法用量使用时，出现的与治疗目的无关的不适反应。毒性反应（B错）是指在剂量过大或药物在体内蓄积过多时发生的危害性反应。后遗效应（C错）是指在停药后，血药浓度已降至最小有效浓度以下时残存的药理效应。继发反应（D错）是继发于药物治疗作用之后的不良反应，是治疗剂量下治疗作用本身带来的间接结果。